生成宗气的脏器是
A. 心
B. 脾
C. 肺
D. 肝
E. 肾

正确答案：C。肺